患者胸胁胀痛，走窜不定，情绪不佳则加重，胸闷气短，嗳气频作，舌苔薄，脉弦。其证候是
A. 肝胃不和
B. 肝络瘀阻
C. 肝气郁结
D. 肝郁化热
E. 肝脾不调

正确答案：C。肝气郁结

解析：本病例以胸胁胀痛为主要临床表现，故诊断为胁痛；肝气失于条达，阻于脉络，故胸胁胀痛；气属无形，时聚时散，聚散无常，故走窜不定；情志变化与气之郁结关系密切，故情绪不佳则加重；肝经气机不畅，故胸闷气短；舌苔薄，脉弦，为肝郁之象，故其证候为肝气郁结证（C对）。（ABDE错）。